叶对生，茎方形、表面紫棕色或淡绿色，有特殊清凉香气的药材是
A. 淡竹叶
B. 薄荷
C. 广金钱草
D. 鱼腥草
E. 穿心莲

正确答案：B。薄荷

解析：本题考查的是薄荷药材的性状鉴别。叶对生，茎方形、表面紫棕色或淡绿色，有特殊清凉香气的药材是薄荷（B对）。薄荷：【性状鉴别】药材茎呈方柱形，有对生分枝；表面紫棕色或淡绿色，棱角处具茸毛；质脆，断面白色，髓部中空。叶对生，有短柄；叶片皱缩卷曲，完整者展平后呈宽披针形、长椭圆形或卵形；上表面深绿色，下表面灰绿色，稀被茸毛，有凹点状腺鳞。轮伞花序腋生，花萼钟状，先端5齿裂，花冠淡紫色。揉搓后有特殊清凉香气，味辛凉。淡竹叶（A错）：【性状鉴别】药材茎呈圆柱形，有节，表面淡黄绿色，断面中空。叶鞘开裂。叶片披针形，有的皱缩卷曲；表面浅绿色或黄绿色。叶脉平行，具横行小脉，形成长方形的网格状，下表面尤为明显。体轻，质柔韧。气微，味淡。广金钱草（C错）：【性状鉴别】药材茎呈圆柱形，长可达1m；密被黄色伸展的短柔毛；质稍脆，断面中部有髓。叶互生，小叶1或3，圆形或矩圆形；先端微凹，基部心形或钝圆，全缘；上表面黄绿色或灰绿色，无毛，下表面具灰白色紧贴的绒毛，侧脉羽状；叶柄长1～2cm；托叶1对，披针形，长约0.8cm。气微香，味微甘。鱼腥草（D错）：【性状鉴别】药材鲜鱼腥草茎呈圆柱形；上部绿色或紫红色，下部白色，节明显，下部节上生有须根，无毛或被疏毛。叶互生，叶片心形；先端渐尖，上表面绿色，密生腺点，下表面常紫红色；叶柄细长，基部与托叶合生成鞘状。穗状花序顶生。具鱼腥气，味涩。穿心莲（E错）：【性状鉴别】药材茎呈方柱形，多分枝，节稍膨大；质脆，易折断。单叶对生，叶柄短或近无柄；叶片皱缩、易碎，完整者展开后呈披针形或卵状披针形，先端渐尖，基部楔形下延，全缘或波状；上表面绿色，下表面灰绿色，两面光滑。气微，味极苦。